结构中含有6-羟基-1，2，4-三嗪-5-酮杂环，产生独特的非线性剂量依赖性的β-内酰胺类抗生素是
A. 头孢氨苄
B. 氨苄西林
C. 头孢呋辛
D. 阿莫西林
E. 头孢曲松

正确答案：E。头孢曲松

解析：本题考查抗感染药的性质和代谢。头孢曲松（E对）是在C3位上引入酸性较强的杂环6-羟基-1，2，4-三嗪-5-酮，以钠盐的形式注射给药，可广泛于分布全身组织和体液，可以透过血脑屏障，在脑脊液中达到治疗浓度。